慢性牙髓炎疼痛特点不包括
A. 不明显的阵发性隐痛
B. 每日可出现定时的钝痛
C. 有时有剧烈的自发性疼痛
D. 有长期的冷、热刺激痛史
E. 患者一般多能定位患牙

正确答案：C。有时有剧烈的自发性疼痛

解析：本题考查慢性牙髓炎的疼痛特点。因为慢性牙髓炎的炎症不明显、渗出物不多，对牙髓的刺激轻微，所以患牙一般不发生剧烈的自发性疼痛（C错，为本题的正确答案），但有时可出现不甚明显的阵发性隐痛（A对）或者每日出现定时钝痛（B对）。慢性牙髓炎的患牙受冷热刺激可出现疼痛，因为病程较长，所以患者可诉有很长时间的冷、热刺激痛史（D对）。发生慢性牙髓炎的患牙病程较长，炎症多已波及全部牙髓及根尖部的牙周膜，因为牙周膜有痛觉感受器和本体感受器，所以患者一般可定位患牙（E对）。